既息风止痉，又通络止痛的药是
A. 僵蚕
B. 熊胆
C. 蒺藜
D. 羚羊角
E. 全蝎

正确答案：E。全蝎

解析：本题考查的是全蝎的功效。既息风止痉，又通络止痛的药是全蝎（E对）。全蝎：【功效】息风止痉，攻毒散结，通络止痛。僵蚕（A错）：【功效】息风止痉，祛风止痛，化痰散结。蒺藜（C错）：【功效】平肝，疏肝，祛风明目，散风止痒。羚羊角（D错）：【功效】平肝息风，清肝明目，凉血解毒。熊胆（B错）的功效，2022年考试指南未明确说明。